别嘌醇临床用于治疗
A. 高血压
B. 帕金森病
C. 抑郁症
D. 痛风
E. 失眠

正确答案：D。痛风

解析：本题考查别嘌醇的适应症。别嘌醇临床用于治疗痛风（D对）。别嘌醇的适应症有高尿酸血症、痛风、痛风石，不包括高血压（A错）、帕金森病（B错）、抑郁症（C错）、失眠（E错）。